以下对放射性不敏感的肿瘤中，不包括
A. 骨肉瘤
B. 纤维肉瘤
C. 脂肪肉瘤
D. 尤文（Ewing）肉瘤
E. 恶性黑色素瘤

正确答案：D。尤文（Ewing）肉瘤

解析：对放射线不敏感的肿瘤有：骨肉瘤、纤维肉瘤、肌肉瘤、腺癌、脂肪肉瘤、恶性黑色素瘤等。掌握“口腔颌面部肿瘤的治疗原则及预防”知识点。